吗啡戒断症状产生主要是由于
A. 去甲肾上腺能神经活性増强
B. 胆碱能神经活性增强
C. 多巴胺能神经活性增强
D. 5-羟色胺能神经活性增强
E. 脑啡肽能神经活性增强

正确答案：A。去甲肾上腺能神经活性増强

解析：吗啡戒断症状产生主要是由于去甲肾上腺能神经活性増强。停用吗啡时，吗啡对依赖者的蓝斑核系统的作用消失，但分布在蓝斑核中的去甲肾上腺能神经活性増强（A对）后并未减弱，从而出现一系列的植物神经系统功能紊乱症状，即戒断症状。多巴胺能神经活性增强（C错）主要是吗啡缓解疼痛所引起的不愉快、焦虑等情绪和致欣快的药理作用。胆碱能神经活性增强（B错）主要表现为亨廷顿舞蹈病。5-羟色胺能神经活性增强（D错）与此无关。脑啡肽功能与吗啡的镇痛功能类似，脑啡肽能神经活性增强（E错）可减轻患者疼痛感。